X线片中表现为骨质破坏沿着牙槽突开始破坏，类似牙周病样骨质吸收表现的是系统性疾病中的
A. 嗜酸性肉芽肿-颌骨体型
B. 嗜酸性肉芽肿-牙槽突型
C. 骨纤维异常增殖症
D. 局限性侵袭性牙周炎
E. 急性中央性颌骨骨髓炎

正确答案：B。嗜酸性肉芽肿-牙槽突型

解析：本题考查嗜酸性肉芽肿。X线片中表现为骨质破坏沿着牙槽突开始破坏，类似牙周病样骨质吸收表现的是系统性疾病中的嗜酸性肉芽肿-牙槽突型（B对）。嗜酸性肉芽肿又称局限性组织细胞增生症，颌骨的病变X线表现分为牙槽突型及颌骨体型两类。牙槽突型病变从牙槽突开始，沿着牙槽突破坏骨质，类似牙周病样骨质吸收表现。颌骨体型病变常开始于下颌体内，以溶骨性破坏为主，可有颌骨膨胀，骨膜反应及密质骨断裂。